一清颗粒主治火毒血热所致的身热烦躁、目赤口疮、大便秘结，其功能是
A. 清热泻火解毒，化瘀凉血止血
B. 清胃泻火，化瘀消肿
C. 清热泻火，散风止痛
D. 清热泻火，利尿通便
E. 清热解毒，消肿止痛

正确答案：A。清热泻火解毒，化瘀凉血止血

解析：本题考查的是一清颗粒的功能。一清颗粒主治火毒血热所致的身热烦躁、目赤口疮、大便秘结，其功能是清热泻火解毒，化瘀凉血止血（A对）。一清颗粒【功能】清热泻火解毒，化瘀凉血止血。清胃黄连丸（片）【功能】清胃泻灭（B错），解毒消肿。牛黄上清丸【功能】清热泻火，散风止痛（C错）。导赤丸【功能】清热泻火，利尿通便（D错）。芩连片【功能】清热解毒，消肿止痛（E错）。